息止颌间隙的范围是
A. 2～4mm
B. 3～5mm
C. 5～10mm
D. 15～25mm
E. 25～37mm

正确答案：A。2～4mm

解析：当人直立或端坐，两眼平视前方，不咀嚼、不吞咽、不说话时，提顿肌群轻微收缩以对抗下颌骨所承受的重力，上下颌牙之间有一前大后小的楔形间隙，约2～4mm（A对），称为息止牙颌间隙。此时下颌所处的位置，称为下颌姿势位。掌握“下颌姿势位、三类颌位与前伸、侧方（牙合）颌位”知识点。